α-葡萄糖苷酶抑制剂常见不良反应是
A. 低血糖症
B. 腹胀和腹泻
C. 下肢浮肿
D. 乳酸性酸中毒
E. 充血性心力衰竭

正确答案：B。腹胀和腹泻

解析：α-葡萄糖苷酶抑制剂的降血糖机制主要是通过抑制小肠上皮细胞刷状缘的α-葡萄糖苷酶，使淀粉和蔗糖等分解为葡萄糖的速度减慢，吸收缓慢，而使餐后血糖降低。未被吸收的淀粉、蔗糖等则在肠道细菌作用下被分解，产气增多，引起胃肠道症状，表现为腹胀和腹泻（B对）。单用α-葡萄糖苷酶抑制剂一般不引起低血糖症（A错）。下肢浮肿（C错）为胰岛素的常见不良反应。乳酸性酸中毒（D错）为双胍类药物最严重的不良反应。充血性心力衰竭（E错）的为格列酮类口服降糖药物的不良反应。